经济发达国家的膳食结构中的显著特点是
A. 富含膳食纤维
B. 优质蛋白质较少
C. 以植物性食物为主
D. 摄入饱和脂肪酸较多
E. 维生素A、维生素B₂和钙的摄入均较少

正确答案：D。摄入饱和脂肪酸较多